胸廓内动脉
A. 起于锁骨下动脉第二段
B. 发分支至心包、膈、胸前壁等处
C. 其终支肌膈动脉穿膈至腹直肌
D. 紧靠胸骨外侧缘下行
E. 向每一肋间隙发出1条肋间前动脉

正确答案：B。发分支至心包、膈、胸前壁等处

解析：胸廓内动脉发分支至心包、膈、胸前壁等处（B对）。其终支腹壁上动脉（C错）穿膈至腹直肌。距胸骨外侧缘约1cm（D错）下降。其终支肌膈动脉分布于下五个肋间隙前部（E错）发出肋间前动脉。